下列哪种因素可导致左心室后负荷过度？
A. 肺循环阻力增加
B. 体循环阻力增加
C. 回心血量增加
D. 主动脉瓣关闭不全
E. 二尖瓣关闭不全

正确答案：B。体循环阻力增加

解析：心室负荷过重又可分为前负荷（心室收缩前承受的负荷）过重、后负荷（心室射血时克服的阻力）过重，主动脉瓣关闭不全（D错）、二尖瓣关闭不全（E错）可使心脏舒张时左心室充盈压（前负荷）升高。体循环阻力增加（B对）如高血压、主动脉瓣狭窄导致左心室射血时需要克服的阻力（后负荷）增加。同理，肺循环阻力增加（A错）如肺动脉高压、肺动脉瓣狭窄可使右心室后负荷增加。回心血量增加（C错）如严重贫血、动-静脉瘘等可使左、右心室前负荷都增加。